男，16岁，发热4天伴纳差2天急诊。检查：血压114/70mmHg，左脚拇趾甲沟部红肿破溃，血白细胞计数为20×10⁹/L，中性粒细胞为89%。左拇趾经切开引流处理后应给予
A. 大剂量青霉素
B. 激素
C. 退热剂
D. 庆大霉素
E. 维生素

正确答案：A。大剂量青霉素

解析：该患者左脚拇指甲沟部红肿破溃，白细胞及中性粒细胞升高，提示为左拇指甲沟部感染——甲沟炎。其致病菌多为金黄色葡萄球菌，属革兰阳性菌，对青霉素敏感。故在经切开引流处理后应给予大剂量青霉素（A对）。激素（B错）对免疫有抑制作用，不利于感染的控制。退热剂（C错）为基础对症治疗，不能很好控制病情发展。庆大霉素（D错）为氨基糖苷类，仅对革兰阴性菌有效。维生素（E错）无助于外科感染的治疗。